变异性心绞痛患者首选药物是
A. 胺碘酮
B. 卡托普利
C. 利多卡因
D. 硝苯地平
E. 普萘洛尔

正确答案：D。硝苯地平